劳动条件的组成中，不包括
A. 生产工艺过程
B. 生产企业环境
C. 健康监护
D. 生产设备布局
E. 操作体位和方式

正确答案：C。健康监护

解析：本题考查劳动条件的组成。劳动条件包括：①生产工艺过程（A对），指用特定的方法从各种原材料制成各种成品的全过程；②劳动过程，它涉及针对生产工艺流程的劳动组织、生产设备布局（D对）、作业者操作体位和劳动方式（E对），以及智力劳动、体力劳动比例等；③生产环境（B对），指生产作业的环境条件，包括室内作业环境和周围大气环境，以及户外作业的大自然环境。健康监护（C错，为本题正确答案）不在劳动条件的范畴中。